甲药品批发企业委托具备药品干线运输能力的乙物流公司为其承运药品，乙物流公司明知该批药品已超过有效期，但依然坚持承运该批药品。关于乙物流公司承运该批药品的行为，应当定性为
A. 以销售假药共同犯罪论处
B. 从非法渠道购进药品
C. 以销售劣药共同犯罪论处
D. 向非法渠道销售药品

正确答案：C。以销售劣药共同犯罪论处

解析：本题考查生产、销售、使用假药、劣药的法律责任。甲药品批发企业委托具备药品干线运输能力的乙物流公司为其承运药品，乙物流公司明知该批药品已超过有效期，但依然坚持承运该批药品。关于乙物流公司承运该批药品的行为，应当定性为以销售劣药共同犯罪论处（C对）。为生产、销售假、劣药品提供运输、保管、仓储等便利条件的主体应承担的法律责任：根据《药品管理法》规定，知道或者应当知道属于假药、劣药或者124条第一款第一项至第五项的药品，而为其提供储存、运输等便利条件的，没收全部储存、运输收入，并处违法收入一倍以上五倍以下的罚款；情节严重的，并处违法收入五倍以上十五倍以下的罚款；违法收入不足五万元的，按五万元计算。该规定旨在发挥法律的威慑作用，打击与制售假劣药品有关的违法犯罪行为。根据最高人民法院、最高人民检察院《关于办理危害药品安全刑事案件适用法律若干问题的解释》第九条规定，明知他人生产、销售、提供假药、劣药，而提供生产、经营场所、设备或者运输、储存、保管、邮寄、网络销售渠道等便利条件的，以生产、销售、提供假药、劣药的共同犯罪论处（A错）。以生产、销售、提供假药、劣药的共同犯罪论处的情形还包括：明知他人生产、销售、提供假药、劣药，而提供资金、贷款、账号、发票、证明、许可证件的；或者提供生产技术或者原料、辅料、包装材料、标签、说明书的；或者提供虚假药物非临床研究报告、药物临床试验报告及相关材料的；或者提供广告宣传；或者提供其他帮助的。共同犯罪的，对各共同犯罪人合计判处的罚金应当在生产、销售假药、劣药金额的二倍以上。药品经营企业不得从非法渠道购进药品（B错）；不得向非法渠道销售药品（D错）。